更改药品内包装材料，主要应考察其与药品的
A. 合法性
B. 相容性
C. 相关性
D. 安全性
E. 稳定性

正确答案：B。相容性